治疗痴呆脾肾两虚证，应首选
A. 七福饮
B. 还少丹
C. 转呆丹
D. 知柏地黄丸
E. 河车大造丸

正确答案：B。还少丹

解析：痴呆脾肾两虚证是由于气血亏虚，肾精不足所致，治疗应补肾健脾，益气生精，方选还少丹（B对）。七福饮为痴呆髓海不足证的选方，功能益气养血，滋阴补肾（A错）。转呆丹多用于治疗痴呆痰浊蒙窍伴有肝郁化火，灼伤肝血心液所致心烦躁动，言语颠倒，歌笑不休，甚至反喜污秽者（C错）。知柏地黄丸可用于痴呆伴肝肾阴虚，阴虚火旺之证，功能滋阴降火（D错）。河车大造丸可用于痴呆髓海不足证缓治，功能补肾益精（E错）。